“亢则害，承乃制”说明了五行之间的
A. 相生关系
B. 相克关系
C. 制化关系
D. 相乘关系
E. 相侮关系

正确答案：C。制化关系

解析：“亢则害”是说阴阳六气过于亢盛就会产生伤害作用；“承乃制”是指阴阳任何一方过于亢盛时就会有另一方去制约它，使其不至于过亢，以维持五行的平衡（C对）。相生关系，指木、火、土、金、水之间存在着有序的递相资生、助长和促进的关系（A错）。相克关系，指木、火、土、金、水之间存在着有序的递相克制、制约和抑制的关系（B错）。相乘指五行中所不胜一行对其所胜一行的过度制约或克制（D错）。相侮指五行中所胜一行对其所不胜一行的反向制约和克制（E错）。